约1cm×1cm，中有一粟粒样脓头，坚硬根深，如钉丁之状，疼痛剧烈，左上眼睑肿胀明显，不能睁眼，伴发热头痛。其诊断是
A. 痈
B. 发
C. 疖
D. 疔疮
E. 有头疽

正确答案：D。疔疮

解析：患者的临床表现符合疔疮的特点：根深坚硬，状如钉丁之状，疼痛剧烈，重者有发热（D对）。痈的特点是局部光软无头，红肿疼痛（少数初起皮色不变），结块范围多在6~9cm左右，发病迅速，易肿，易脓，易溃，易敛，或伴有恶寒、发热、口渴等全身症状（A错）。发的特点是初起无头、红肿蔓延成片，中央明显，四周较淡，边界不清，灼热疼痛（B错）。疖特点是肿势局限，范围多小于3cm，突起根浅，色红、灼热、疼痛，易肿、易溃、易敛（C错）。有头疽的特点是初起皮肤上即有粟粒样脓头，焮热红肿疼痛，迅速向深部及周围发生扩散，脓头相继增多，溃烂后状如莲蓬、蜂窝，范围常超过9~12cm（E错）。